洗涤剂引起水体富营养化的主要成分来自
A. 氮
B. 磷
C. 氮和磷
D. 酶
E. 光亮剂

正确答案：B。磷

解析：本题考查洗涤剂引起水体富营养化的主要成分。洗涤剂引起水体富营养化的主要成分来自磷（B对ACDE错）。近年来由于大量使用合成洗涤剂，其中部分产品的磷酸盐含量高达30%～60%，使污水中磷含量显著增加，为水生植物提供充足的营养物质。受含磷、氮等污水污染造成水体中藻类大量繁殖，使水中有机物增加、溶解氧下降，水质恶化的现象，形成水体富营养化。